有对照（比较）组的研究，其共同的逻辑学基础是
A. 求同法
B. 差异法
C. 同异并用法
D. 共变法

正确答案：C。同异并用法

解析：本题考查同异并用法。有对照（比较）组的研究，其共同的逻辑学基础是同异并用法（C对ABD错）。同异并用法是求同法和差异法的并用，包括求同、差异和求同与差异的比较，相当于同一研究中设有比较（对照）组，用以控制干扰因素。